女，55岁。因甲状腺功能亢进症行甲状腺次全切除术后1小时，突感呼吸困难。查体：面色青紫，颈部肿胀。引起呼吸困难最可能的原因是
A. 气管塌陷
B. 双侧喉返神经损伤
C. 切口内出血
D. 喉上神经内外支损伤
E. 甲状腺危象

正确答案：C。切口内出血

解析：气管塌陷（A错）是气管壁长期受肿大甲状腺压迫，发生软化，切除甲状腺体的大部分后软化的气管壁失去支撑的结果，一般于术后1～3小时内出现，可引起呼吸困难，但气管塌陷并不能解释颈部肿胀。双侧喉返神经损伤（B错）时支配声带的肌肉瘫痪，声带处于内收位、声门关闭，常在全麻气管插管拔出后立即出现呼吸困难，无颈部肿胀。一般来讲，切口内出血（C对）导致的呼吸困难发展较慢，多在术后24～48小时出现，亦可发生于术后1小时，表现为颈部肿胀，切口可有渗血。喉上神经内外支损伤（D错）表现为音调降低，进食特别是饮水时，容易误咽发生呛咳。甲状腺危象（E错）常表现为高热、脉快，同时合并神经、循环及消化系统功能紊乱如烦躁、谵妄、大汗、呕吐、水泻等。部分医考参考书依据呼吸困难发生于术后1小时断定正确答案为A，并未考虑如何解释颈部肿胀。在实际临床工作中，发病时间仅能作为参考，临床表现才是最主要的诊断依据。